中华人民共和国执业医师法，适用于
A. 依法取得执业医师资格的人
B. 依法取得执业医师资格或执业助理医师资格的专业医务人员
C. 依法取得执业医师资格或执业助理医师资格，在医疗机构中执业的专业医务人员
D. 依法取得执业医师资格或执业助理医师资格，经注册在医疗机构中执业的专业医务人员
E. 依法取得执业医师资格或执业助理医师资格，经注册在医疗保健预防机构中执业的专业医务人员

正确答案：E。依法取得执业医师资格或执业助理医师资格，经注册在医疗保健预防机构中执业的专业医务人员

解析：《中华人民共和国执业医师法》第一章第二条：依法取得执业医师资格或者执业助理医师资格，经注册在医疗保健预防机构中执业的专业医务人员（E对），适用本法。